婴幼儿最易发生急性喉水肿的部位
A. 喉前庭
B. 喉中间腔
C. 声门下腔
D. 前庭裂
E. 无

正确答案：C。声门下腔

解析：婴幼儿最易在声门下腔（C对）发生急性喉水肿。